苏子的功效是
A. 止咳平喘
B. 润肠通便
C. 二者均是
D. 二者均不是

正确答案：C。二者均是

解析：本题考查的是紫苏子的功效。苏子的功效是止咳平喘与润肠通便（C对）。苏子即紫苏子。紫苏子：【功效】降气化痰，止咳平喘（A错），润肠通便（B错）。